女，24岁。腹痛、腹泻、便秘交替2年，大便糊状，脐周疼痛。近一年来消瘦、乏力、贫血。下午有时低热。首先考虑的诊断是
A. 小肠肿瘤
B. 肠结核
C. 溃疡性结肠炎
D. 降结肠癌
E. 升结肠癌

正确答案：B。肠结核

解析：青年患者（24肠结核的好发年龄），腹痛、腹泻、便秘交替2年（肠结核-溃疡型的典型临床表现），大便糊状，脐周疼痛（肠结核腹痛常见位置：右下腹/脐周）近一年来消瘦、乏力、贫血，下午有时低热多见于溃疡型肠结核。（B对），该病腹痛、腹泻、体重下降为主要临床表现，常有发热，大便性状多为糊状，腹痛多位于右下腹及脐周。小肠肿瘤（A错）主要症状为定位不确切的腹痛、便血、腹部肿块。溃疡性结肠炎（C错）主要表现为腹泻、黏液脓血便及左下腹痛。结肠癌（DE错）多见于中老年人，腹痛常为定位不确切的持续性隐痛，还有粪便形状及排便习惯的改变以及腹部包块。